下列哪项是光化学烟雾事件的特点之一
A. 污染物主要来自汽车尾气
B. 多发生在早晨
C. 多发生在冬春季
D. 主要污染物是SO₂
E. 多发生在南北纬度60°以上的地区

正确答案：A。污染物主要来自汽车尾气

解析：本题考查光化学烟雾事件的特点。光化学烟雾事件的污染来源是石油制品燃烧（A对）；主要污染物是VOC、NOₓ、O₃、SO₂、CO、PANs（D错）；发生季节为夏秋季（C错）；发生时间在中午或午后（B错）；多发生在南北纬度60°以下的地区（E错）。